我国《工业企业噪声卫生标准》规定新建企业的噪声容许标准为
A. 85dB（A）
B. 75dB（A）
C. 65dB（A）
D. 55dB（A）
E. 90dB（A）

正确答案：A。85dB（A）

解析：本题考查工作场所噪声的限值。我国现阶段执行的《工业场所有害因素职业接触限值第2部分：物理因素》（GBZ2.2-2007）规定，噪声职业接触限值为每周工作5天，每天工作8小时，稳态噪声限值为85dB（A）（A对BCDE错），非稳态噪声等效声级的限值为85dB（A）；每周工作日不足5天，需计算40小时等效声级，限值为85dB（A）。